可以诊断肝细胞癌
A. AFP＜20μg/ml
B. AFP＞100μg/ml
C. AFP＞200μg/L
D. AFP＞200μg/L持续8周
E. AFP＞400μg/L

正确答案：D。AFP＞200μg/L持续8周

解析：甲胎蛋白是在胎儿早期由肝脏和卵黄囊合成的一种血清糖蛋白，出生后，AFP的合成很快受到抑制。当肝细胞或生殖腺胚胎组织发生恶性病变时，有关基因重新被激活，使原来丧失合成AFP能力的细胞又重新开始合成，以致血中AFP含量明显升高。因此血中AFP浓度检测对诊断肝细胞癌及滋养细胞恶性肿瘤有重要的临床价值。原发性肝细胞癌患者血清AFP增高，阳性率约为70%，在排除妊娠和生殖腺胚胎瘤的基础上，AFP＞400ng/ml 为诊断肝癌的条件之一。对 AFP 逐渐升高不降或＞200 /L， 持续8周，应结合影像学及肝功能变化作综合分析或动态观察（D对）。按九版内科学标准，选项DE均正确。